用二甘醇替代丙二醇所致的假药事件是
A. 欣弗事件
B. 齐二药事件
C. 关木通事件
D. 鱼腥草事件
E. 达菲事件

正确答案：B。齐二药事件

解析：本题考查齐二药事件。齐二药事件（B对）：齐二药厂用二甘醇替代丙二醇生产亮菌甲素注射液，导致患者急性肾衰竭死亡，药监局随后封杀齐二药厂生产的所有药品。